关于化学修饰调节的叙述正确的是
A. 调节酶所发生的化学修饰以乙酰化修饰最多见
B. 化学修饰的酶促反应进行慢
C. 调节酶在酶的催化下所发生的化学修饰是不可逆反应
D. 调节过程无逐级放大作用
E. 多以影响关键酶使代谢发生方向性的变化

正确答案：C。调节酶在酶的催化下所发生的化学修饰是不可逆反应

解析：本题考查化学修饰调节。化学修饰调节的特点：调节酶所发生的共价修饰有多种形式，如磷酸化、甲基化、乙酰化等，其中以磷酸化修饰为最多见。调节酶在酶的催化下所发生的化学修饰是不可逆反应（C对）。